影响血药浓度的生理因素不包括
A. 年龄
B. 性别
C. 胃肠疾患
D. 遗传
E. 体重

正确答案：C。胃肠疾患